颈动脉三角由浅入深的层次是
A. 皮肤、颈浅筋膜、颈深筋膜浅层
B. 颈深筋膜浅层、皮肤、颈浅筋膜
C. 颈浅筋膜、颈深筋膜浅层、皮肤
D. 颈浅筋膜、皮肤、颈深筋膜浅层
E. 皮肤、颈深筋膜浅层、颈浅筋膜

正确答案：A。皮肤、颈浅筋膜、颈深筋膜浅层

解析：颈动脉三角位于胸锁乳突肌上部的前方。层次由浅入深为：皮肤、颈浅筋膜、颈深筋膜浅层。掌握“气管颈段、颈动脉三角的解剖特点及临床应用”知识点。